G-细菌所致的败血症首选药物是
A. 庆大霉素
B. 多西环素
C. 红霉素
D. 链霉素
E. 妥布霉素

正确答案：A。庆大霉素

解析：本题考查氨基苷类抗生素。G-细菌所致的败血症首选药物是庆大霉素（A对）。多西环素（B错）用于细菌、立克次氏体、支原体、衣原体引起的感染。红霉素（C错）是治疗军团菌所致肺炎的首选药物。链霉素（D错）主要与其他抗结核药联合，用于结核分枝杆菌所致各种结核病的初治病例，或其他敏感分枝杆菌感染。妥布霉素（E错）与庆大霉素相同，主要用于各种严重的革兰阴性杆菌感染，但一般不作为首选药。